右上后牙于5天前结束金属烤瓷冠冶疗，患者持续地对冷热刺激敏感，最可能的原因是
A. 戴冠时机械刺激
B. 邻面接触紧密
C. 游离磷酸的刺激
D. 龋坏组织未去净
E. 有咬合高点

正确答案：C。游离磷酸的刺激

解析：本题考查修复后可能出现的问题。金属烤瓷冠修复体粘固不久后，引发患牙持续性地对冷热刺激敏感一般是因不适当的刺激造成的。游离磷酸的刺激（C对）很可能在治疗后不久出现，因酸的持续刺激而激惹牙髓，持续地对冷热刺激敏感。戴冠时机械刺激（A错）会引起患牙短时疼痛，但一般在戴冠后较快消失，不会在5天后仍存在。邻面接触紧密（B错）会出现牙齿胀痛，一般无冷热刺激敏感。龋坏组织未去净（D错）不会在短期出现临床症状，在使用修复体较长时间以后可能引起过敏性疼痛，而且在修复理论和临床工作中一般不大可能龋坏未去净就作全冠修复。有咬合高点（E错）短期内会出现咬合痛，通过调（牙合）症状会很快消失。